男性，58岁，进行性贫血，消瘦乏力半年，有时右腹隐痛，无腹泻。查体：右中腹部扪及肿块，肠鸣音活跃。下列各项检查可明确诊断的是
A. 纤维结肠镜
B. CEA
C. CT
D. B超
E. X线钡餐检查

正确答案：A。纤维结肠镜

解析：患者老年男性，消瘦、乏力，贫血，右中腹肿块（右侧结肠癌的典型症状），考虑为结肠癌，为明确此病最好的诊断方式是活组织病理检查，纤维结肠镜（A对）可以侵入病灶部位直观的了解病灶情况，并获取组织以进行病理检查以明确诊断。CEA（癌胚抗原）（B错）一般用于结肠癌术后复发和预后的判断，且仅有45%病人升高，不具有明确诊断价值。CT（C错）、B超（D错）可用来检查癌肿转移以及淋巴结肿大情况，不适合结肠癌的诊断。X线钡餐检查（E错）效果有限，不具有确诊价值。